下列除哪项外，均为里实热证的表现
A. 身发高热
B. 两颧潮红
C. 口渴饮冷
D. 热汗不止
E. 脉象洪数

正确答案：B。两颧潮红

解析：身发高热，为体内阳热之气过盛，形体壮实所致，为里实热证（A错）。两颧潮红为阴虚内热而阳气偏亢所致，里实热证为面红赤（B对）。口渴饮冷为里热炽盛，灼伤阴液所致，为里实热证（C错）。热汗不止为阳热偏盛，热淫于内，迫津外泄所致（D错）。洪数脉为里热证之象（E错）。